诊断尿路结石首选的X线检查是
A. 逆行肾盂造影
B. 静脉尿路造影
C. 肾动脉造影
D. CT
E. 腹部平片+静脉尿路造影

正确答案：E。腹部平片+静脉尿路造影

解析：腹部平片能发现90%以上的X线阳性结石，正侧位摄片可以除外腹内其他钙化阴影；静脉尿路造影可以显示部分不含钙的阴性结石，表现为充盈缺损或影像增强，故诊断尿路结石首选的X线检查是腹部平片+静脉尿路造影（E对）。逆行肾盂造影（A错）、静脉尿路造影（B错）可以用来评价结石所致肾结构和功能改变，但单独使用不能确定造影所示充盈缺损的原因。肾动脉造影（C错）多用于肾肿瘤及肾血管疾病的诊断，对肾结石诊断价值不大。CT（D错）多用于肾肿瘤的诊断，且价格昂贵，一般不作为结石的首选诊断方法。